本身具有治疗活性，在生物体内转化为无活性和无毒性的化合物是
A. 前药
B. 生物电子等排
C. 代谢拮抗
D. 硬药
E. 软药

正确答案：E。软药